伴有甲状腺功能亢进症的口腔溃疡患者应避免使用的药物是
A. 西地碘含片
B. 替硝唑含漱夜
C. 地塞米松粘贴片
D. 氯己定含漱液
E. 左旋咪唑片

正确答案：A。西地碘含片

解析：本题考查药物相互作用。伴有甲状腺功能亢进症的口腔溃疡患者应避免使用含碘的药物，如西地碘（A对）。替硝唑含漱液（B错）在最新版考试指南未明确说明。频繁应用地塞米松（C错）粘贴片可引起局部组织萎缩。氯己定（D错）偶可引起接触性皮炎。左旋咪唑（E错）用于肠道寄生虫的治疗。